典型的胃食管反流的症状是
A. 进行性吞咽困难
B. 进餐后上腹痛，至下一餐前缓解
C. 不洁饮食后上腹痛，伴呕吐腹泻
D. 空腹及夜间上腹痛，进食后可缓解
E. 反酸、烧心，伴胸骨后烧灼样痛

正确答案：E。反酸、烧心，伴胸骨后烧灼样痛

解析：烧心和反流是胃食管反流病最常见和典型的症状，胸痛是胃食管反流病的非典型症状，故反酸烧心伴胸骨后烧灼样痛是典型的胃食管反流的症状（E对）。进行性吞咽困难是典型的食管癌的症状（A错）。进餐后上腹痛，至下一餐前缓解是典型的胃溃疡的症状（B错）。不洁饮食后上腹痛，伴呕吐腹泻是肠胃炎的典型症状（C错）。空腹及夜间上腹痛，进食后可缓解是典型的十二指肠溃疡的症状（D错）。